为了保证种植体的稳定性，唇颊侧和舌腭侧的骨厚度至少是
A. 0.5mm
B. 1.5mm
C. 2mm
D. 3mm
E. 4mm

正确答案：B。1.5mm

解析：本题考查种植体受植区要求。为了保证种植体的稳定性，唇颊侧和舌腭侧的骨厚度至少是1.5mm（B对）。种植体间距离不能少于3mm，种植体与天然邻牙间的距离不能少于2mm。种植体根端距离下颌管上缘不能少于2mm。一般情况下，种植体长度不应少于8mm。